比较理想的冷冻麻醉剂是
A. 普鲁卡因
B. 利多卡因
C. 地卡因
D. 可卡因
E. 氯乙烷

正确答案：E。氯乙烷

解析：氯乙烷具有冷冻麻醉作用，从而使局部产生快速镇痛效果。掌握“颌面部常用局部麻醉药物”知识点。